单位时间内药物按一定比率消除是
A. 半衰期
B. 清除率
C. 消除速率常数
D. 零级动力学消除
E. 一级动力学消除

正确答案：E。一级动力学消除